甲类传染病是指
A. SARS、狂犬病
B. 黑热病、炭疽
C. 高致病性禽流感、天花
D. 鼠疫、霍乱
E. 伤寒、流行性出血热

正确答案：D。鼠疫、霍乱

解析：鼠疫、霍乱（D对）属于甲类传染病；SARS、狂犬病（A错）属于乙类传染病；黑热病、炭疽（B错）中炭疽属于乙类传染病，黑热病属于丙类传染病；高致病性禽流感、天花（C错）中，高致病性禽流感属于乙类传染病，而天花目前在我国已基本消灭；伤寒、流行性出血热（E错）属于乙类传染病。